医务人员将不符合国家规定标准的血液用于患者，造成患者死亡或者严重损害患者身体健康的，由司法机关追究的法律责任是
A. 违宪责任
B. 行政责任
C. 民事责任
D. 刑事责任
E. 经济责任

正确答案：D。刑事责任

解析：由司法机关追究的均为刑事责任。掌握“医疗机构临床用血管理、及法律责任”知识点。